下列各中成药组中属于合理应用的是
A. 胆宁片与苏合香丸
B. 天麻丸与川贝枇杷露
C. 附子理中丸与通宣理肺丸
D. 补中益气丸与金匮肾气丸

正确答案：D。补中益气丸与金匮肾气丸

解析：本题考查中成药联用的配伍禁忌。下列各中成药组中属于合理应用的是补中益气丸与金匮肾气丸（D对）。含“十八反”“十九畏”药味中成药的配伍禁忌：现行版《中国药典》中有不宜同用药的规定，从不宜同用药的品种来看没有突破“十八反”和“十九畏”所含的品种。“十八反”“十九畏”中的药物，应属配伍禁忌，原则上禁止联用。利胆中成药利胆排石片、胆乐胶囊、胆宁片等都含有郁金，若与六应丸、苏合香丸（A错）、妙济丸、纯阳正气丸、紫雪散等含丁香（母丁香）的中成药同时使用，就要注意具“十九畏”药物的禁忌。治疗风寒湿痹证的大活络丸、尪痹冲剂、天麻丸、人参再造丸等均含有附子，而止咳化痰的川贝枇杷露（B错）、蛇胆川贝液、通宣理肺丸等分别含有川贝、半夏，依据配伍禁忌原则，若将上述两组合用，附子、乌头与川贝、半夏当属相反禁忌同用之列。附子理中丸【药物组成】附子（制）、干姜、党参、白术（炒）、甘草。附子理中丸中含有附子同理不可与通宣理肺丸（C错）同用。含有毒药物中成药的联用：数种功效相似的中成药联用，在各自制剂的组成中，往往有一种或几种相同的药味。因此，联用将会增加某一味或几味药的剂量。如复方丹参滴丸和速效救心丸（E错）同属气滞血瘀型用药，其处方组成与功效基本相似，而且这一类的药物多数含有冰片，由于冰片药性寒凉，服用剂量过大易伤人脾胃，导致胃痛胃寒，故不可过量使用，在临床应用中使用其中一种即可。